米索前列醇所致的主要不良反应是
A. 腹痛
B. 黑便
C. 皮炎
D. 性功能减退
E. 便秘

正确答案：A。腹痛

解析：本题考查米索前列醇的不良反应。米索前列醇最常见的不良反应主要是体温、血压、脉搏和消化系统的症状。包括体温异常升高、血压升高、脉搏加速或者恶心、呕吐、腹泻、头晕、腹痛（A对）等。